某患者，60岁。右下6因松动于三个月前拔除，要求修复。义齿设计的支持形式为
A. 牙支持式
B. 黏膜支持式
C. 混合支持式
D. 基托支持式
E. 杆支持式

正确答案：A。牙支持式

解析：本题考查局部义齿的设计。Kennedy第三类的设计要点：义齿的（牙合）力主要由基牙负担，为牙支持式（A对），故缺牙间隙两侧的基牙均要放置（牙合）支托。